属于时间依赖型抗菌药物，抗菌谱窄，仅对需氧革兰阴性菌有效的药物
A. 阿米卡星
B. 氨曲南
C. 氨苄西林
D. 头孢他啶
E. 头孢曲松

正确答案：B。氨曲南

解析：本题考查抗菌药物。属于时间依赖型抗菌药物，抗菌谱窄，仅对需氧革兰阴性菌有效的药物氨曲南（B对）。阿米卡星（A错）属于氨基糖苷类药物，浓度依赖型。氨苄西林（C错）为半合成的广谱青霉素，属氨基青霉素类，其抗菌作用机制与青霉素相同。头孢他啶（D错）属于第三代头孢菌素，通常铜绿假单胞菌对其敏感。头孢曲松（E错）也属第三代头孢菌素，但对铜绿假单胞菌作用不及头孢他啶。